某小学校160名学生，在饭店定做课间餐，学生在当天上午8:50～9:00食用，大约3小时后，其中有79人出现头晕、腹痛、腹泻、恶心、呕吐。腹泻主要是黄绿色水样便，每日数次至10余次。腹痛多在上腹部，伴有压痛，体温一般在38～40℃。根据以上症状判断本次食物中毒是属于下列哪种食物中毒
A. 沙门菌中毒
B. 副溶血性弧菌中毒
C. 葡萄球菌肠毒素中毒
D. 肉毒梭菌中毒
E. 酵米面中毒

正确答案：A。沙门菌中毒